以下关于尼龙丝优点说法错误的是
A. 耐磨性强
B. 回弹力好
C. 易吸水变软
D. 刷毛较细
E. 是一种优质材料

正确答案：C。易吸水变软

解析：本题考查尼龙丝刷毛的种类特点。以下关于尼龙丝优点说法错误的是易吸水变软（C错，为本题正确答案）。优质尼龙丝在水中充分浸泡后，其硬度下降小。尼龙丝是一种优质材料（E对）。优质尼龙丝，其直径为0.20mm及以下，细软（D对），吸水性差，回弹力好（B对），耐磨性强（A对），可进入牙邻间区及龈沟区，清除邻面及龈下菌斑。